膀胱肿瘤最常见的组织类型是
A. 腺癌
B. 内翻性乳头状瘤
C. 移行细胞癌
D. 横纹肌肉痛
E. 鳞癌

正确答案：C。移行细胞癌

解析：膀胱肿瘤最常见的组织类型是移行细胞癌（C对），占90%以上，其次为鳞癌（E错）和腺癌（A错）；非上皮性肿瘤最少，约占1%～5%，多为肉瘤（D错）。内翻性乳头状瘤（B错）属于移形细胞癌的一种，为良性肿瘤，较少见。